急性一氧化碳中毒时，为什么应尽早采用高压氧治疗
A. 加速HbCO的解离
B. 加速HbCO的合成
C. 减少HbCO的合成
D. 提高肺氧分压
E. 提高血氧分压

正确答案：A。加速HbCO的解离

解析：本题考查一氧化碳中毒的毒作用机制。CO与Hb结合形成HbCO，是急性CO中毒引起机体缺氧窒息最主要的机制，经呼吸道吸入的CO绝大部分与Hb发生紧密而可逆性结合，形成HbCO使Hb失去携氧能力，导致组织缺氧。CO与Hb的亲和力比O₂与Hb的亲和力大，少量CO即可与O₂竞争，生成大量HbCO，阻碍氧的释放，故导致低氧血症和组织缺氧。及时测定血中HbCO含量可作为反映CO中毒严重程度的参考指标。停止接触后，O₂可缓慢地取代CO，重新形成HbO₂。因此高压氧疗可加速HbCO解离（A对BCDE错）。